急性乳腺炎常见致病菌
A. 金黄色葡萄球菌
B. 大肠杆菌
C. 结核杆菌
D. 白色葡萄球菌
E. 溶血性链球菌

正确答案：A。金黄色葡萄球菌

解析：急性乳腺炎常见致病菌为金黄色葡萄球菌（A对）。